易侵犯中枢神经系统的白血病是
A. 急性粒细胞性白血病
B. 急性单核细胞性白血病
C. 急性早幼粒细胞性白血病
D. 急性淋巴细胞性白血病
E. 慢性粒细胞性白血病

正确答案：D。急性淋巴细胞性白血病

解析：中枢神经系统是白血病最常见的髓外浸润部位，可发生在疾病各个时期，尤其是治疗后缓解期，以急性淋巴细胞白血病（D对）最常见。急性粒细胞白血病（P571）（A错）易并发绿色瘤；急性单核细胞白血病（P571）（B错）易并发牙龈增生、肿胀；急性早幼粒细胞白血病（P571）（C错）易并发弥散性血管内凝血；慢性粒细胞白血病（P577）（E错）易并发巨脾。